测360名对象的某指标，算得均数等于87，中位数等于73，标准差等于65，第5百分位数等于7，第95百分位数等于233，则估计该指标值90％的对象在范围
A. 87±1.96×65
B. 87±1.64×65
C. 73±1.96×65
D. 73±1.64×65
E. 7～233

正确答案：E。7～233

解析：本题考查的是百分位数的相关内容。因本题均数与中位数不相等，则不是正态分布，不能用正态分布法进行估计。需要用百分位数，该指标值90％的对象在范围7～233（E对ABCD错），此方法是基于百分位数法估计90％参考值范围。